手足蠕动的病机是
A. 热极生风
B. 血虚生风
C. 阴虚动风
D. 肝阳化风
E. 寒凝筋脉

正确答案：C。阴虚动风

解析：阴虚风动的主要病机是津液枯竭，阴气大伤，失其凉润柔和，既对筋脉失之滋润，又不能制阳而致阳气相对亢盛所以出现手足蠕动的症状（C对）。热极生风多出现痉挛、抽搐、鼻翼煽动、目睛上吊等临床表现，常伴有高热、神昏、谵语（A错）。血虚生风临床见肢体麻木不仁，筋肉跳动、甚则手足拘挛不伸等症。此外，尚有血燥生风（B错）。肝阳化风，可见筋悌肉瞤、肢麻震颤、眩晕欲仆，甚则口眼歪斜、半身不遂。严重者，则因血随气升而发猝然厥仆（D错）。寒凝筋脉临床可见痛处固定，遇寒加重（E错）。